隐匿性维生素D缺乏性手足搐搦症特有的阳性体征是
A. 克氏征
B. 巴氏征
C. 布氏征
D. 霍夫曼征
E. 面神经征

正确答案：E。面神经征

解析：隐匿性维生素D缺乏性手足搐搦症特有的阳性体征是面神经征（E对）：以手指尖或叩诊锤骤击患儿腭弓与口角间的面颊部（第7脑神经孔处），引起眼睑和口角抽动为面神经征阳性，新生儿期可呈假阳性。巴氏征（B错）、霍夫曼征（D错）指锥体束病损时的病理反射。克氏征（A错）、布氏征（C错）属于脑膜刺激征（九版诊断学P218-P219）。